妊娠月份已足，腹痛或作或止，腰不痛者，称为
A. 临产
B. 盛胎
C. 试胎
D. 弄胎
E. 正产

正确答案：D。弄胎

解析：妊娠月份已足，腹痛或作或止，腰不痛者，称为弄胎（D对）。临产是指产妇已进入产程。主要标志为：有规律并且逐渐增强的宫缩，持续30秒或以上，间歇5-6分钟，同时伴随进行性宫颈管消失、宫口扩张和胎先露部下降，用镇静药物不能抑制（A错）。盛胎，即激经，指怀孕后仍按月行经，并无其他症状，又无损于胎儿，待胎儿渐长，其经自停（B错）。月数未足腹中痛，痛定如常名试胎（C错）。正产是指胎儿足月后正常产出（E错）。